甲是药品上市许可持有人，依法持有甲钴胺片等药品品种；乙是药品生产企业，生产范围：片剂，胶囊剂；丙是药品生产企业，生产范围：胶囊剂，颗粒剂；丁是全国性药品批发企业，经营范围：麻醉药品、中成药、中药饮片、化学药、生物制品，具备药品现代物流条件；戊是县级区域性药品批发企业，经营范围：中成药、化学药；己是药品零售连锁企业所属门店，经营类别：处方药、甲类非处方药，乙类非处方药，经营范围：第二类精神药品、中成药、中药饮片，化学药。药品监督管理部检查发现己从个人处购进药品并销售，情节较轻，应当依法依规做出的处罚是
A. 责令改正，没收违法购进的药品和违法所得，并处违法购进药品货值金额二倍以上十倍以下的罚款，货值金额不足五万元的，按五万元计算
B. 给予警告，责令限期改正，逾期不改正或者情节严重的，处以一千元以上三千元以下的罚款
C. 没收违法销售的药品和违法所得，并处违法销售药品货值金额十倍以上二十倍以下的罚款，货值金额不足一万元的，按一万元计算
D. 责令限期改正，予以警告：逾期不改正的，处十万元以上五十万元以下的罚款

正确答案：A。责令改正，没收违法购进的药品和违法所得，并处违法购进药品货值金额二倍以上十倍以下的罚款，货值金额不足五万元的，按五万元计算

解析：本题考查违反药品监督管理规定的法律责任。甲是药品上市许可持有人，依法持有甲钴胺片等药品品种；乙是药品生产企业，生产范围：片剂，胶囊剂；丙是药品生产企业，生产范围：胶囊剂，颗粒剂；丁是全国性药品批发企业，经营范围：麻醉药品、中成药、中药饮片、化学药、生物制品，具备药品现代物流条件；戊是县级区域性药品批发企业，经营范围：中成药、化学药；己是药品零售连锁企业所属门店，经营类别：处方药、甲类非处方药，乙类非处方药，经营范围：第二类精神药品、中成药、中药饮片，化学药。药品监督管理部检查发现己从个人处购进药品并销售，情节较轻，应当依法依规做出的处罚是责令改正，没收违法购进的药品和违法所得，并处违法购进药品货值金额二倍以上十倍以下的罚款，货值金额不足五万元的，按五万元计算（A对）。根据《药品管理法》第一百二十九条的规定，药品上市许可持有人、药品生产企业、药品经营企业或者医疗机构未从药品上市许可持有人或者具有药品生产、经营资格的企业购进药品的，责令改正，没收违法购进的药品和违法所得，并处违法购进药品货值金额二倍以上十倍以下的罚款（D错）；情节严重的，并处货值金额十倍以上三十倍以下的罚款（B错），吊销药品批准证明文件、药品生产许可证、药品经营许可证或者医疗机构执业许可证；货值金额不足五万元的，按五万元计算（C错）。